牙髓感染时细胞释放的介质中能促进骨吸收的是
A. 前列腺素E2
B. 白三烯B4
C. 白细胞介素-1
D. 肿瘤坏死因子β
E. 以上均是

正确答案：E。以上均是

解析：本题考查能促进骨吸收的介质。前列腺素E2（A对）、白三烯B4（B对）、IL-6（白细胞介素-6）（C对）和TNF（肿瘤坏死因子）（D对）有促进骨吸收的作用（ABCD均对，E为本题的正确答案）。